男，22岁。上课时突然手中钢笔掉落，两眼向前瞪视，呼之不应，持续数秒钟。过后对上述情况全无记忆，以后反复有类似发作，有时1天发作几次。本题患者诊断为
A. 失神发作
B. 癔症
C. 局限性癫痫
D. 复杂部分性发作
E. 肌阵挛发作

正确答案：A。失神发作

解析：青年男性患者，上课时突然手中钢笔掉落，两眼向前瞪视，呼之不应，持续数秒钟，过后对上述情况全无记忆，以后反复有类似发作，有时1天发作几次，该患者的表现为典型的失神发作（A对）。局限性癫痫即癫痫部分性发作（C错）表现身体某部分如颜面或口角抽动、个别手指或单侧肢体持续不停抽动达数小时或数天，无意识障碍发作终止后可遗留发作部位Todd麻痹，也可扩展为继发性全面性发作。癫痫复杂部分发作（D错）在发作开始的时候，大多为简单部分性发作的形式，然后会出现意识障碍，或者是伴有各种自动症。肌阵挛发作（E错）表现为身体某一部分的一组肌群突然快速收缩,可以出现点头、拥抱或者突然身体向一侧偏斜、跌倒等，是癫痫的一种常见发作形式。癔症（分离（转换）障碍）（B错）症状丰富多变，在轻微不愉快的生活事件（与本例严重精神刺激不符）作用下反复发作，且发作具有明显的表演性、夸张性、做作性、躯体转换症状。